小儿暑温急性期的传变规律是
A. 沿卫、气、营、血迅速传变
B. 卫之后方言气，营之后方言血
C. 沿上、中、下三焦传变
D. 犯肺传胃，终入肝肾
E. 热生风，风生痰，痰生惊

正确答案：A。沿卫、气、营、血迅速传变

解析：本病为感染暑温邪毒而发病，传变途径为卫、气、营、血，暑温发病急骤，最易传变，按卫气营血辨证较为符合（A对）。暑温循卫、气、营、血传变，严重者，径入营血，非卫之后方言气，营之后方言血（B错）。小儿暑温急性期无明显的三焦传变（C错）。由肺及胃，终入肝肾亦为三焦辨证中的一部分（D错）。热生风，风生痰，痰生惊为小儿暑温的最突出的病理特点，非传变规律（E错）。